临床急救的伦理要求中错误的是
A. 争分夺秒的抢救
B. 争名利，冒险蛮干
C. 承担风险，团结协作
D. 满腔热情，重视心理治疗
E. 全面考虑，维护社会公益

正确答案：B。争名利，冒险蛮干

解析：临床急救的伦理要求：（一）争分夺秒地抢救，力争使患者转危为安；（二）勇担风险，团结协作；（三）满腔热情，重视心理治疗；（四）全面考虑，维护社会公益。B项错误。临床急救中优柔寡断、光考虑自己得失的态度和作风是不可取的；另外，为出风头、争名利的冒险蛮干也是缺乏医德的表现。掌握“临床治疗和临床急救的伦理”知识点。